氯化物检查法中，为避免单质银析出，采取的方法是
A. 加入稀硝酸10mL
B. 加水成40mL后，再加硝酸银试液1mL
C. 放置5min后比浊
D. 比浊前在暗处放置
E. 加入硝酸银试液1.0mL，反复滤过至澄清

正确答案：D。比浊前在暗处放置

解析：本题考查氯化物检查法。为了避免光线使单质银析出，在观察前应在暗处放置5分钟（D对）。